某学者为探讨某药物对某病的疗效，选取了120例该患者，随机分为服用该药的治疗组和使用标准疗法的对照组，随访观察时，观察者与患者均不知道两组接受的措施，一个月后，观察疗效，结果治疗组60名患者中有40人有效，对照组60名中有20人有效，经统计学检查，两组差异具有统计学意义。由结果推出的结论为
A. 标准疗法无效
B. 该药对该疾病无效
C. 资料不足，尚不能下结论
D. 该药对该疾病有效
E. 该药对该疾病的治疗效果低于标准疗法的疗效

正确答案：D。该药对该疾病有效

解析：治疗组有效率为66.7%，对照组有效率=20/60×100%=33.3%， 经统计学检验，两组差异具有统计学意义，说明治疗组有效率高于对照组有效率（D对） 。